属于小细胞低色素性贫血的是
A. 巨幼细胞贫血
B. 再生障碍性贫血
C. 慢性病性贫血
D. 缺铁性贫血
E. 小细胞性贫血

正确答案：D。缺铁性贫血

解析：本题考查缺铁性贫血。属于小细胞低色素性贫血的是缺铁性贫血（D对）。1.缺铁性贫血是铁缺乏症（包括ID、IDE和IDA）的最终阶段，表现为缺铁引起的小细胞低色素性贫血及其他异常。2.叶酸或维生素B₁₂（Vit B₁₂）缺乏或某些影响核苷酸代谢的药物导致细胞核脱氧核糖核酸（DNA）合成障碍所致的贫血称巨幼细胞贫血（A错）。本病的特点是呈大红细胞性贫血，骨髓内出现巨幼红细胞、粒细胞及巨核细胞系列。3.再生障碍性贫血（B错）简称再障，是一种可能由不同病因和机制引起的骨髓造血功能衰竭症。主要表现为骨髓造血功能低下、全血细胞减少及所致的贫血、出血、感染综合征。4.慢性病性贫血（C错）通常是指继发于其他系统疾病，如慢性感染、恶性肿瘤、肝脏病、慢性肾功能不全及内分泌异常等。直接或间接影响造血组织而导致的一组慢性贫血。这一类也是老年人最常见的贫血。5.小细胞性贫血（E错）包括：缺铁性贫血，珠蛋白生成障碍性贫血，血红蛋白病，铁粒幼细胞性贫血，铅中毒和铜缺乏性贫血，以及少数慢性病引起的贫血。